患者每逢生气后，即咳逆阵作，痰滞咽喉，咳之不出，胸胁胀痛，咳时面赤，口苦咽干，舌红苔薄黄，脉弦数。治疗应首选
A. 二陈汤合柴胡疏肝散
B. 黄芩泻白散合黛蛤散
C. 桑白皮汤合柴胡疏肝散
D. 清金化痰汤合桔梗汤
E. 龙胆泻肝汤合黛蛤散

正确答案：B。黄芩泻白散合黛蛤散

解析：肝气郁结化火，上逆侮肺，肺失肃降，以致每逢生气后，即咳逆阵作；木火刑金，炼液成痰故见痰滞咽喉咳之不出，痰黏或呈絮状，难于咯吐；肝脉布于两胁，上注于肺，肝肺不和，故见胸胁胀痛；肝火上炎故咳时面赤，口苦咽干；舌红苔薄黄，脉弦数，为典型的肝火犯肺，肺气上逆的表现，治疗需清肝泻肺，化痰止咳，方药选用黛蛤散合泻白散加减（B对）。二陈汤合柴胡疏肝散（A错）可以燥湿化痰，舒肝理气，用于治疗气滞痰阻证。桑白皮汤合柴胡疏肝散（C错）可以疏肝理气，清热化痰，用于治疗痰热阻肺证。清金化痰汤合桔梗汤（D错）可以清热肃肺，化痰止咳，用于治疗痰热郁肺证。龙胆泻肝汤合黛蛤散（E错）可以清肝泻火，理气止咳，治疗肝火上炎证。